属于影响牙周病流行的因素的是
A. 口腔卫生习惯
B. 民族因素
C. 营养状况
D. 全身系统性疾病
E. 以上都是

正确答案：E。以上都是

解析：影响牙周病流行的因素除地区、时间、年龄、性别及民族等因素外，牙周病的患病情况还受到其他因素如口腔卫生习惯、吸烟、营养和全身系统性疾病的影响。掌握“牙周病流行病学及分级预防”知识点。